蛋白质生物学价值的高低主要取决于
A. 所含氨基酸的数量
B. 表观消化率
C. 含量
D. 真消化率
E. 所含必需氨基酸的含量和比值

正确答案：E。所含必需氨基酸的含量和比值